前牙唇侧适合用什么肩台
A. 浅凹
B. 深凹
C. 带斜面的直角
D. 肩台
E. 刃状

正确答案：B。深凹

解析：本题考查修复体龈边缘设计应合乎牙周组织健康的要求。前牙唇侧适合用深凹（B对）肩台。深凹槽边缘：增加凹槽边缘的宽度。修复体边缘具有足够的厚度，准确清晰。深凹槽边缘是临床上常用的一种设计,可用于烤瓷熔附金属冠的唇面边缘及全瓷冠的边缘。浅凹（A错）槽边缘：临床上常用于铸造金属全冠、部分冠以及烤瓷熔附金属冠的舌侧金属边缘。带斜面的直角（C错）肩台：多用于PFM冠。肩台（D错）边缘：常用于烤瓷熔附金属冠唇侧边缘及全瓷冠边缘。刃状（E错）边缘：常用于倾斜牙的倾斜面。